下列哪一项不是青春期第二性征发育的特点
A. 乳房发育增大
B. 乳晕增大、色素加深
C. 月经来潮
D. 腋毛发育
E. 阴毛发育

正确答案：C。月经来潮

解析：本题考查青春期第二性征发育的特点。月经来潮（C错，为本题正确答案）是女孩青春期来临和性成熟过程中的一项重要标志。女孩青春期第二性征发育的特点表现为乳房发育增大（A对）、乳晕增大、色素加深（B对）、骨盆宽大、腋毛发育（D对）、阴毛发育（E对）、嗓音尖细等。